大腿后群肌
A. 4块
B. 内侧为股二头肌
C. 外侧为半腱肌和半膜肌
D. 屈膝关节和伸髋关节
E. 屈髋关节和伸膝关节

正确答案：D。屈膝关节和伸髋关节

解析：大腿后群肌共3块，而非4块（A错）；股二头肌在外侧，而非内侧（B错）；半腱肌和半膜肌在内侧，而非外侧（C错）；作用是屈膝关节和伸髋关节（D对），而非屈髋关节和伸膝关节（E错）。